关于急性盆腔炎性疾病的处理，正确的是
A. 病情好转，盆腔脓肿存在者，继续观察
B. 可根据经验选择抗生素治疗
C. 喹诺酮类药物可作为首选
D. 需反复行妇科检查评估治疗效果
E. 放置宫内节育器者，应立即取出

正确答案：B。可根据经验选择抗生素治疗

解析：病情好转，盆腔脓肿存在者，应行手术治疗（A错）。抗生素的治疗原则：经验性、广谱、及时和个体化。初始治疗往往根据病史、临床表现以及当地的流行病学推断病原体，给予经验性抗生素治疗（B对）。目前由于耐氟喹诺酮类药物淋病奈瑟菌株的出现，氟喹诺酮类药物不作为盆腔炎性疾病的首选药物（C错）。尽量避免不必要的妇科检查以免引起炎症扩散（D错），有腹胀者应行胃肠减压。放置宫内节育器者，应先控制炎症，再根据需要是否取出（E错）。